男，32岁。发热、乏力、纳差、腹胀2个月。体温T37.9℃。查体：T37.5℃，P80次/分，R18次/分，BP120/80mmHg。双肺呼吸音清，未闻及干湿性啰音，心律齐，腹壁柔韧感，移动性浊音阳性。实验室检查：血沉60mm/h，腹水：比重1.025，蛋白35g/L，白细胞850×10⁶/L，单核0.80，多核0.20。首先考虑的诊断是
A. 结核性腹膜炎
B. Budd-Chiari综合征
C. 肝硬化并原发性腹膜炎
D. 系统性红斑狼疮
E. 腹膜转移癌

正确答案：A。结核性腹膜炎

解析：青年男性，发热、乏力、纳差、腹胀（结核毒性症状）。体温T37.9℃（低热，37.3～38℃），腹壁柔韧感，移动性浊音阳性（有腹腔积液）。实验室检查见血沉60mm/h（增快，正常值男性0～15mm/h，与纤维蛋白原增高有关），腹水：比重1.025（增加，正常值1.018），蛋白35g/L（增加），白细胞850×10⁶/L（增高，正常值500×10⁶/L），单核0.80（增多，正常值0.03～0.08），多核0.20（减少，正常值0.5～0.7）。根据患者临床表现和实验室检查，怀疑为结核性腹膜炎，结核性腹膜炎（A对）所导致的腹腔积液为渗出液，比重高于1.018、蛋白定量大于30g/L，细胞计数常大于500×10⁶，以淋巴细胞为主。Budd-Chiari综合征（B错）即布加综合征，由下腔静脉堵塞引起的门静脉高压，引起的腹腔积液为漏出液。肝硬化并原发性腹膜炎（C错）引起的腹腔积液为漏出液。系统性红斑狼疮（D错）为自身免疫性疾病，腹腔积液中细胞以嗜酸性粒细胞为主。腹膜转移癌（E错）所致的胸腔积液往往为血性，并可以查找到癌细胞。